在经典途径、旁路途经、凝集素途径中均起作用的补体成分是
A. C1δ
B. C1γ
C. C2
D. C3
E. C4

正确答案：D。C3

解析：补体经典途径、旁路途径和凝集素途径中均起作用的补体成分是C3。掌握“补体的概念，激活途径及调节”知识点。